患布氏杆菌病的牛所产的奶应作何处理
A. 销毁
B. 发酵
C. 可制作奶酪用
D. 巴氏消毒
E. 喂饲其他禽畜

正确答案：D。巴氏消毒